肠相关淋巴组织不包括
A. 肠道PP
B. 固有层
C. M细胞
D. 肠系膜淋巴结
E. 肌层淋巴细胞

正确答案：E。肌层淋巴细胞